张某，建筑工人。工作期间突然发病，高热，大量出汗，随后皮肤干热，伴有意识障碍和昏迷等中枢神经系统症状。测量工地发现WBGT指数39℃。张某最可能被诊断为
A. 热痉孪
B. 热衰竭
C. 热射病
D. 热适应
E. 肺炎

正确答案：C。热射病